由国内各学科医药权威专家，根据临床用药经验并结合国内外公认的资料编写的三级文献是
A. 《中国药典临床用药须知》
B. 《中国医药年鉴》
C. 《药学学报》
D. 《中国药典》
E. 《生物学文摘》

正确答案：A。《中国药典临床用药须知》

解析：本题考查《临床治疗指南》。《中国药典临床用药须知》（A对）是一类由循证医学催生发展的三级信息资源。《中国医药年鉴》（B错）为二级文献。《药学学报》（C错）为一级文献。《中国药典》（D错）为三级文献。《生物学文摘》（E错）为二级文献。